X线显示日光放射状骨膜反应的疾病是
A. 骨囊肿
B. 骨巨细胞瘤
C. 骨软骨瘤
D. 骨肉瘤
E. 骨纤维异常增殖症

正确答案：D。骨肉瘤

解析：X线显示日光放射状骨膜反应为骨肉瘤的典型表现（D对）。骨囊肿（A错）X线片常表现为干骺端圆形或椭圆形界限清楚的溶骨性病灶。骨巨细胞瘤（B错）X线片特征性表现为骨端偏心性、溶骨性、囊性破坏而无骨膜反应。骨软骨瘤（C错）X线表现为干骺端从皮质突向软组织的骨性突起。骨纤维异常增殖症（P780）（E错）亦称骨纤维发育不良，X线表现为受累骨骼膨胀变粗，密质骨变薄，典型特征是呈磨砂玻璃样改变，界限清楚。